“阴中求阳，阳中求阴”治法的理论依据是
A. 阴阳协调平衡
B. 阴阳对立制约
C. 阴阳互根互用
D. 阴阳相互转化
E. 阴阳互为消长

正确答案：C。阴阳互根互用

解析：阴阳自和，指阴阳双方自动维持和自动恢复其协调稳定状态的能力和趋势。阴阳虽然属性相反，但两者存在互生、互化、互制、互用等关系，在交互作用的变化中相反相成，是维持事物或现象协调发展的内在机制（A错）。阴阳对立，指阴阳“一分为二”，即对待、相反的关系，是事物或现象固有的属性。阴阳对立制约的意义在于防止阴阳的任何一方不至于亢盛为害，以维持阴阳之间的协调平衡（B错）。阴阳互根，指阴阳的互为根本、相互依存的关系，即："阳根于阴，阴根于阳"。阳的根本在阴，阴的根本在阳，双方互为存在的前提（C对）。阴阳转化，指事物的阴阳属性，在一定条件下可以向其相反的方向转化，即属阳的事物可以转化为属阴的事物，属阴的事物可以转化为属阳的事物（D错）。阴阳消长，指阴阳双方不是静止不变的，而是处于不断的消减和增加的运动变化之中。消，减少、减退；长，增加、增长（E错）。